芒硝入汤剂,其用法是
A. 先煎
B. 后下
C. 包煎
D. 冲服
E. 另煎

正确答案：D。冲服

解析：本题考查芒硝的用法，需理解记忆。芒硝的用法用量是10-15g，冲入药汁内或开水融化后服。外用适量（D对）。无色晶体，易溶于水。